下列抗菌药物中最常引起再生障碍性贫血是
A. 头孢曲松钠
B. 青霉素
C. 亚胺培南﹣西司他丁钠
D. 头孢他啶
E. 氯霉素

正确答案：E。氯霉素